血栓性疾病的维持治疗宜选用
A. 华法林
B. 肝素
C. 噻氯匹定
D. 氨甲苯酸
E. 链激酶

正确答案：A。华法林

解析：本题考查华法林。华法林（A对）可抑制羧基化酶，起效缓慢，仅在体内有效，停药后药效持续时间较长，可用于血栓性疾病的维持治疗。肝素（B错）为抗凝剂，用于防治血栓形成或栓塞性疾病。噻氯匹定（C错）对二磷酸腺苷（ADP）诱导的血小板聚集有较强的抑制作用；对胶原、凝血酶、花生四烯酸、肾上腺素及血小板活化因子等诱导的血小板聚集亦有抑制作用。氨甲苯酸（D错）属于抗纤维蛋白溶解药。链激酶（E错）为溶栓药，临床用于急性心肌梗死等血栓性疾病。